经过几十年疾病的分布状态等逐渐发生显著的趋势性变化
A. 季节性
B. 周期性
C. 短期波动
D. 遗传性
E. 长期变异

正确答案：E。长期变异

解析：长期变异：经过一个相当长的时期（通常为几年或几十年），疾病的分布状态、感染类型、临床表现等逐渐发生显著的趋势性变化，这种现象称为长期变异。掌握“流行病学资料与疾病分布”知识点。